长期服用氯丙嗪后出现的不良反应中，哪一反应用抗胆碱药治疗反可使之加重
A. 体位性低血压
B. 静坐不能
C. 帕金森综合征
D. 迟发性运动障碍
E. 急性肌张力障碍

正确答案：D。迟发性运动障碍